急性乳腺炎最常见于
A. 妊娠期妇女
B. 初产哺乳的妇女
C. 哺乳半年后的妇女
D. 长期哺乳的妇女
E. 乳头凹陷的妇女

正确答案：B。初产哺乳的妇女